肛门有下坠感，劳累后加重的临床意义是
A. 肝郁气滞
B. 大肠湿热
C. 肾气不固
D. 中气下陷
E. 肠道气滞

正确答案：D。中气下陷

解析：若患者觉肛门重坠，甚或脱肛，头晕乏力，面色少华者，为脾虚气陷。因脾气亏虚，中气下陷，清气不升，故有肛门下坠感（D对）。肝郁气滞者，可见排便困难或便干（A错）；大肠湿热者，肛门重坠，腹痛窘急，时时欲泻，大便黄褐臭秽，或见脓血便者（B错）；肾气不固者，多为老年人或久病患者小便频数，色清量多，夜间明显（C错）；肠道气滞者，排便不爽，有涩滞（E错）。